心动周期指
A. 心脏机械活动周期
B. 心脏生物电活动周期
C. 心律变化周期
D. 室内压变化周期
E. 心音活动周期

正确答案：A。心脏机械活动周期